囊虫病的传染源是
A. 猪肉绦虫病病人
B. 牛肉绦虫病病人
C. 囊虫病病人
D. 猪
E. 牛

正确答案：A。猪肉绦虫病病人